女，30岁。1年来乏力，易疲倦，腰部不适，有时下肢浮肿，未检查。2个月来加重，伴纳差，血压增高为150/100mmHg，下肢轻度浮肿。尿蛋白（+），沉渣RBC5～10/HP，偶见颗粒管型，血化验Hb90g/L，血肌酐400μg/L。最可能的诊断是
A. 慢性肾盂肾炎
B. 慢性肾小球肾炎
C. 肾病综合征
D. 狼疮肾炎
E. 急性肾炎

正确答案：B。慢性肾小球肾炎

解析：中青年女性，病程1年，加重2月，表现为易疲倦，腰部不适，有时下肢浮肿，查体：血压150/100mmHg（2级高血压），下肢轻度浮肿。实验室检查：尿蛋白（+），沉渣RBC5～10/HP（正常值0～3个/HP），偶见颗粒管型，血化验Hb90g/L（成年女性：110～150g/L，提示轻度贫血），血肌酐400μg/l【正常值（女）70～108μmol/L，提示肾功能失代偿】。该患者存在肾小球肾炎的典型临床表现（水肿、高血压、蛋白尿、血尿），有提示肾功能受损的实验室检查，且病程长达1年，故最可能的诊断即慢性肾小球肾炎（B对）。慢性肾盂肾炎（A错）多有反复发作的泌尿系统感染史，尿沉渣中常有白细胞（P493），与该患者病史及临床表现不符。肾病综合征（C错）诊断标准是：①尿蛋白大于3.5g/d；②血浆白蛋白低于30g/L；③水肿；④血脂升高。其中①②两项为诊断所必须（P470），该患者明显不符合肾病综合征表现。狼疮肾炎（D错）患者常伴有狼疮临床表现（间断发热，颧部蝶形红斑，盘状红斑，光过敏，口腔溃疡，关节炎，浆膜炎，神经病变等），该患者无任何狼疮的临床表现，故可排除。急性肾炎（E错）多有前驱感染性，急性起病，病情多在8周内恢复正常，本病持续一年，故排除急性肾炎。